关于糖皮质激素抗炎作用的正确叙述是
A. 对抗各种原因如物理、生物等引起的各种炎症
B. 能提高机体的防御功能
C. 促进创口愈合
D. 抑制病原体生长
E. 直接杀灭病原体

正确答案：A。对抗各种原因如物理、生物等引起的各种炎症

解析：糖皮质激素强大的抗炎作用，能对抗多种原因（物理性、化学性、生物性、免疫性、无菌性等）引起的炎症（A对）。但必须注意，急性炎症反应是机体的一种防御反应，炎症后期的反应也是组织修复的重要过程，因此糖皮质激素在抑制炎症、减轻水肿的同时，也降低了机体的防御（B错）和修复功能，可导致感染扩散和延缓创口愈合（C错）。糖皮质激素抗炎作用的基本机制在于通过糖皮质激素与靶细胞胞浆内的糖皮质激素受体相结合，抑制参与炎症反应的一些基因转录而产生抗炎效应，并不是通过抑制病原体生长（D错）或直接杀灭病原体（E错）。